对癫痫大发作或部分性发作疗效好的药物是
A. 苯妥英钠
B. 乙琥胺
C. 苯巴比妥钠
D. 卡马西平
E. 丙戊酸钠

正确答案：A。苯妥英钠